下列哪一项不是休克肺主要的临床表现？
A. 进行性氧分压降低
B. 进行性呼吸困难
C. 进行性高碳酸血症
D. 进行性发绀
E. 肺部有湿性罗音

正确答案：C。进行性高碳酸血症

解析：休克后期由于休克肺的发生，患者因通气、换气功能障碍，所以可有进行性氧分压降低（A对）、进行性呼吸困难（B对）、进行性发绀（D对）和肺部有湿性罗音（E对）等临床表现；又可出现呼吸性酸中毒（C错，为本题正确答案），使机体处于混合性酸碱失衡状态。